地中海贫血
A. 红细胞脆性增加
B. 红细胞脆性降低
C. 红细胞酶缺陷
D. 血清铁蛋白减少
E. Coomb's试验

正确答案：B。红细胞脆性降低

解析：本题考查地中海贫血的相关内容。地中海贫血是由于遗传的基因缺陷致使血红蛋白中一种或一种以上珠蛋白链合成缺如或不足所导致的贫血或病理状态。红细胞大小不等，中央浅染区扩大，出现异形、靶形等，骨髓象呈红细胞系统增生明显活跃，以中、晚幼红细胞占多数，成熟红细胞改变与外周血相同。红细胞脆性明显降低（B对ACDE错）。HbF含量明显增高，这是诊断重型β地贫的重要依据。